女子婚后未避孕，有正常性生活，丈夫查精液常规正常，同居2年未受孕者，称为
A. 断绪
B. 不育
C. 全不产
D. 绝对不孕
E. 五不女

正确答案：C。全不产

解析：有过妊娠而后不孕者，古称“断绪”（A错）。男性不育指夫妇同居未采取避孕措施两年以上，而无生育者。女方检查正常，男方检查异常，中医称本病为“无嗣”（B错）。凡婚后未避孕、有正常性生活、同居2年而未受孕者，称为不孕症，从未妊娠者古称‘全不产’（C对）。夫妇一方有先天或后天生殖器官解剖生理方面缺陷或损伤，无法纠正而不能妊娠者，称绝对性不孕（D错）。“五不女”：螺、纹、鼓、角、脉，即生殖器畸形者不能婚配、生育（E错）。